第—胎，停经37周，直至1周前血压均正常。近1周下肢水肿。有头昏，视力模糊症状。血压21/13.3kPa（154/100mmHg），尿蛋白（+），尿E3：36.44μmol/24h（10.5mg/24h），听胎心音正常，下列处理哪项最合适
A. 积极治疗，38周时终止妊娠
B. 积极治疗，等待自然分娩
C. 终止妊娠
D. 立即人工破膜加静脉滴注催产素引产
E. 立即剖宫产

正确答案：C。终止妊娠

解析：孕妇有妊高症，为轻度子痫前期，应在积极内科治疗控制症状后终止妊娠。掌握“娠期高血压疾病”知识点。